男，43岁。3天前自非洲回北京，回京后开始发冷、寒战，继之高热，持续3小时后出汗、热退，每两天发作1次。血涂片见疟原虫滋养体。应选择的治疗方案是
A. 磺胺加乙胺嘧啶
B. 青蒿素加另一种抗疟药
C. 青蒿素加氯喹
D. 奎宁加伯氨喹
E. 乙胺嘧啶加伯氨喹

正确答案：B。青蒿素加另一种抗疟药

解析：疟疾治疗:  伯父杀青预订旅馆
氯喹――最常用最有效，控制病情，管  旅馆
伯氨喹――控制复发  伯父
乙胺嘧啶――用于预防  预啶
青蒿素――同时杀死细胞内外虐原虫  杀青
所以治疗方案应为青蒿素加另一种抗疟药B对）。